患者，男，66岁。有高血压病史10余年。2年来双下肢发凉麻木，时有小腿部抽痛及间歇性跛行，近来足痛转为持久性静止痛，夜间尤甚，往往抱膝而坐，足背动脉搏动消失，其诊断是
A. 血栓闭塞性脉管炎
B. 雷诺氏病
C. 糖尿病足
D. 动脉硬化性闭塞症
E. 动脉栓塞

正确答案：D。动脉硬化性闭塞症

解析：血栓闭塞性脉管炎多发于寒冷季节，以20-40岁男性多见；常先一侧下肢发病，继而累及对侧，少数患者可累及上肢；患者多有受冷、潮湿、嗜烟、外伤等病史（A错）。雷诺综合征多见于青年女性；上肢较下肢多见，好发于双手；每因寒冷和精神刺激后双手出现发凉苍白，继而紫绀、潮红，最后恢复正常的三色变化（雷诺现象），患肢动脉搏动正常，一般不出现肢体坏疽（B错）。糖尿病足多伴有糖尿病病史，尿糖、血糖增高，可累计大动脉和微小动脉（C错）。动脉硬化性闭塞症多发于老年人，常伴有高脂血症、高血压和动脉硬化病史，常累及大中动脉。患者为老年男性，有高血压病史。2年来双下肢发凉麻木，时有小腿部抽痛及间歇性跛行，近来足痛转为持久性静止痛，夜间尤甚，往往抱膝而坐，足背动脉搏动消失，符合动脉硬化性闭塞症的特征（D对）。动脉栓塞是一种全身性疾患，可发生在全身大、中动脉，但以腹主动脉远侧及髂-骰-腘动脉最为常见，病变后期可以累及腘动脉远侧的主干动脉，由于动脉腔狭窄或闭塞，引起下肢动脉慢性缺血的表现（E错）。